腰椎间盘突出症最多见的是
A. 腹痛
B. 下肢痉挛瘫
C. 坐骨神经痛
D. 急性尿潴留
E. 巴彬斯基征阳性

正确答案：C。坐骨神经痛

解析：腰椎间盘突出症常见于20～50岁的病人，主要表现为腰痛、坐骨神经痛、马尾综合征，由于大约95%的椎间盘突出发生在腰4、5及腰5、骶1，而坐骨神经又源自腰4、5及骶1～3神经，故腰椎间盘突出症多累及坐骨神经损伤，故最多见的是坐骨神经痛（C对）。腰椎间盘突出症患者一般不出现腹痛（A错）。下肢痉挛瘫（B错）多见于脊髓损伤，脊髓多止于腰1平面，故腰椎间盘突出症一般不会引起脊髓压迫的症状。当腰椎间盘突出合并有马尾神经受压时，可出现大小便障碍，急性尿潴留（D错）等。巴彬斯基征阳性（E错）多发生在锥体束损伤中，故腰间盘突出症巴彬斯基征阴性。